大豆的限制氨基酸和含量相对较高的氨基酸分别是
A. 色氨酸、甲硫氨酸
B. 甲硫氨酸、赖氨酸
C. 赖氨酸、色氨酸
D. 亮氨酸、苯丙氨酸
E. 苯丙氨酸、苏氨酸

正确答案：B。甲硫氨酸、赖氨酸